关于牙龈纤维瘤病增生的牙龈描述不正确的是
A. 颜色正常
B. 组织坚韧
C. 表面偶呈颗粒状
D. 点彩明显
E. 易出血

正确答案：E。易出血

解析：牙龈纤维瘤病增生的牙龈可覆盖部分或整个牙冠，以致妨碍咀嚼。增生牙龈的颜色正常，组织坚韧，表面光滑，有时也呈颗粒状或小结节状，点彩明显，不易出血。掌握“牙龈纤维瘤病”知识点。